男性，45岁。外伤致骨盆骨折、会阴部撕裂伤，术后尿潴留，烦躁不安，最佳处理方法是
A. 肌注安定10毫克
B. 下腹部热敷
C. 口服止痛药
D. 静注氨甲酰甲胆碱
E. 留置导尿管

正确答案：E。留置导尿管

解析：中年男性患者，因外伤导致骨盆骨折及会阴部撕裂伤，术后尿潴留，提示可能存在尿道的损伤，应首先插入导尿管（E对）引流，既可避免尿潴留，又可作为尿道不全撕裂伤的生长修复支架。而肌注安定10毫克（A错）、下腹部热敷（B错）、口服止痛药（C错）及静注氨甲酰甲胆碱（D错）均只是针对症状所采取的缓解措施，而没有真正地解决尿潴留，故均不是最佳处理方法。